医疗机构施行特殊治疗，无法取得患者意见又无家属或者关系人在场，或者遇到其他特殊情况时，主治医师应当提出医疗处置方案，在取得
A. 病房负责人同意后实施
B. 科室负责人同意后实施
C. 医疗机构质监部门负责人批准后实施
D. 医疗机构负责人或者被授权负责人批准后实施
E. 科室全体医师讨论通过后实施

正确答案：D。医疗机构负责人或者被授权负责人批准后实施

解析：医疗机构施行特殊治疗，无法取得患者意见又无家属或者关系人在场，或者遇到其他特珠情况时，主治医师应当提出医疗处置方案，在取得医疗机构负责人或者被授权负责人批准后实施（D对）。